氯丙嗪抗精神病的作用机制是阻断
A. 中枢α-肾上腺素能受体
B. 中枢β-肾A腺素能受体
C. 中脑-边缘系和中脑-皮质通路D2受体
D. 黑质-纹状体通路中的5-HT1受体
E. 结节-漏斗通路的D2受体

正确答案：C。中脑-边缘系和中脑-皮质通路D2受体

解析：氯丙嗪等吩噻嗪类药物主要是通过拮抗中脑-边缘系统和中脑-皮层系统的D2样受体而发挥疗效的。掌握“氯丙嗪”知识点。